患者，60岁，诉于外院充填治疗后咬合时左侧下后牙疼痛2天。检查见：左上6铸造全冠修复，左下6远中邻（牙合）面银汞充填，充填体完好，边缘密合，温度刺激反应同正常牙，咬合纸检查未见高点，叩（-）龈（-），则正确的治疗措施为
A. 左下6根管治疗
B. 拔除左下6
C. 左下6换以复合树脂充填
D. 左下6去除旧充，安抚2周后玻璃离子充填
E. 左下6铸造冠修复

正确答案：C。左下6换以复合树脂充填

解析：本题考查充填后疼痛的原因及处理方法。检查可见左上6铸造全冠修复，左下6远中邻（牙合）面银汞充填，两种金属为异种金属；引起疼痛的原因可能是，上下牙接触时，两异种金属间形成电位差，产生电流引起疼痛，其治疗措施为，去除左下6银汞合金充填物，改用复合树脂等非导体类材料进行充填（C对），或改用作同类金属的嵌体修复。患牙温度刺激反应同正常牙，说明牙髓活力正常，左下6无需做根管治疗或安抚治疗（AD错）。左下6更换充填材料之后，可正常使用，无需拔除（B错）。若左下6铸造冠修复，则需对左下6进行牙体预备，相较于充填修复来讲，冠修复对牙体组织的损伤更大，不宜采用（E错）。